鸡血藤的原植物属于
A. 木犀科
B. 茜草科
C. 豆科
D. 五加科
E. 瑞香科

正确答案：C。豆科

解析：本题考查的是鸡血藤的来源。鸡血藤的原植物属于鸡血藤（C对）。鸡血藤：【来源】为豆科植物密花豆的干燥藤茎。来源于木犀科（A错）的中药有秦皮、连翘、女贞子等。来源于茜草科（B错）的中药有巴戟天、茜草、钩藤、栀子、白花蛇舌草等。来源于五加科（D错）中药有人参、红参、三七、通草等。来源于瑞香科（E错）的中药有沉香等。